提呈（外源性）抗原的细胞是
A. NK细胞
B. B细胞
C. 肥大细胞
D. 细胞毒性T淋巴细胞
E. 浆细胞

正确答案：B。B细胞